下列不属于血管紧张素转化酶抑制剂（ACEI）特点的是
A. 引起反射性心率加快
B. 可用于各型高血压
C. 对肾脏有保护作用
D. 可防治高血压患者心肌细胞肥大
E. 减少循环组织中的血管紧张素Ⅱ

正确答案：A。引起反射性心率加快